羌活为治疗何种头痛之要药
A. 少阳经头痛
B. 肝经头痛
C. 太阳经头痛
D. 阳明经头痛
E. 风热头痛

正确答案：C。太阳经头痛

解析：羌活的应用于风寒湿痹，本品辛散祛风、味苦燥湿、性温散寒，有较强的祛风湿，止痛作用，常与其他祛风湿，止痛药配伍，主治风寒湿痹，肢节疼痛。因其善入足太阳膀胱经，以除头项肩背之痛见长治疗太阳经头痛（C对）。少阳经头痛常用川穹（A错）。巅顶头痛常用藁本（B错）。阳明经头痛常用白芷（D错）。